下列哪项是虚热证与实热证的鉴别要点
A. 发热口干
B. 盗汗颧红
C. 大便干结
D. 小便短赤
E. 舌红而干

正确答案：B。盗汗颧红

解析：本题考的是实热与虚热的区别，出现盗汗是因为阴虚阳亢，入睡则卫阳由表入里，内热加重，蒸津外泄而汗出；醒后卫阳由里出表，内热减轻而汗止。盗汗是虚热证的独特表现（B对）。虚热证中出现发热口干是因为阴不制阳，虚火内扰；实热证中出现发热口干为热邪内盛，火热上炎。故选项A为两者的共同点（A错）。虚热证中出现大便干结是因为阴液不足，虚热内生；实热证中出现大便干结为热结肠胃。故选项C为两者的共同点（C错）。虚热证中出现小便短赤是因为阴液亏损，虚火内扰；实热证中出现小便短赤为热邪伤阴。故选项D为两者的共同点（D错）。虚热证中出现舌红而干是因为虚火上升；实热证中出现舌红而干为热邪侵袭，津液受伤。故选项E为两者的共同点（E错）。